正确描述肺段的是
A. 按支气管、肺动脉、肺静脉在肺内的分支分布把肺分为若干个肺段
B. 左肺有两个肺段,右肺有三个肺段
C. 各肺段均呈圆锥形,其底朝向肺门
D. 肺段支气管主干末端直接与肺泡相连
E. 肺段可视为一独立性结构单位

正确答案：E。肺段可视为一独立性结构单位

解析：肺段可视为一独立性结构单位（E对）。按支气管在肺内的分支分布把肺分为若干个肺段（A错）。左肺有8个肺段,右肺有10个肺段（B错）。各肺段均呈圆锥形，其尖朝向肺门（C错）。全部各级支气管在肺叶内反复分支直达肺泡管，共分23 -25级（D错）。